疲劳性骨折最常发生于
A. 肱骨
B. 尺骨和桡骨
C. 第二跖骨
D. 股骨
E. 跟骨

正确答案：C。第二跖骨